慢性再生障碍性贫血病人最常见的感染是
A. 败血症
B. 肠道感染
C. 尿路感染
D. 上呼吸道感染
E. 皮肤感染

正确答案：D。上呼吸道感染

解析：慢性再生障碍性贫血（即非重型再生障碍性贫血）患者全血细胞减少，白细胞减少，容易发生感染，以上呼吸道感染最为常见（D对）。败血症（A错）较常见于重型再生障碍性贫血，但较少见于非重症再生障碍性贫血，不如呼吸道感染常见；肠道感染（B错）、尿路感染（C错）、皮肤感染（E错）在再生障碍性贫血在均不如上呼吸道感染常见。